68岁，胃部大手术，口腔黏膜刺激痛2月，双侧舌背黏膜片状充血，丝状乳头萎缩。诊断
A. 扁平苔薛
B. 舌淀粉样舌炎
C. 裂纹舌
D. 地图舌
E. 萎缩性舌炎

正确答案：D。地图舌

解析：本题考查地图舌的诊断。患者68岁，有胃部大手术史，口腔黏膜刺激痛，双侧舌背黏膜片状充血，丝状乳头萎缩，可诊断为地图舌。地图舌又称地图样舌，是一种浅表性非感染性的舌部炎症。好发于舌背、舌尖、舌缘部，病损多在舌前2/3，一般不越过人字沟。病损由周边区和中央区组成。中央区表现为丝状乳头萎缩呈剥脱样，黏膜表面光滑、充血发红且微凹。扁平苔藓（A错）病损为小丘疹连成的线状白色、灰白色花纹，类似皮肤损害的Wickham纹，属角化异常病损。病损大多左右对称，可发生在口腔黏膜任何部位，包括舌、牙龈、前庭、唇、腭、口底等部位，以颊部最为多见。舌淀粉样舌炎（B错）是淀粉样物质沉积在口腔的早期表现，是一种少见的蛋白代谢紊乱引起的全身多脏器受累的综合征。裂纹舌（C错）即沟纹舌，表现为舌背一条或长或短的中心深沟和多条不规则的副沟。萎缩性舌炎（E错）是指舌黏膜的萎缩性改变。表现为舌背丝状乳头先出现萎缩，伴有或不伴有口干、烧灼感等非特异性症状。继而菌状乳头萎缩，红肿，舌背光滑色红或苍白无舌苔，口腔其他部位黏膜也可出现萎缩。